某女，67岁。大便秘结，二三日一行，量少，排出不畅，面色无华，头晕目眩，心悸，口干；舌淡，苔少，脉细涩。宜采用的治法是
A. 养血润燥
B. 清热润肠
C. 顺气行滞
D. 温通开秘
E. 泻下导滞

正确答案：A。养血润燥

解析：本题考查大肠液亏证的治法。患者为大肠液亏证，宜采用的治法是养血润燥（A对）。大肠液亏证的临床表现及辨证要点：大肠液亏证的临床表现，常见大便秘结干燥，难于排出，往往数日一次，可兼见头晕、口臭等症，脉涩或细，舌红少津或可见黄燥苔。一般以大便干燥难于排出为辨证要点。【治法】养血润燥。便秘之热秘【症状】大便干结，腹胀腹痛，口干口臭，面红心烦，或有身热，小便短赤。舌红，苔黄燥，脉滑数。【治法】泻热导滞（E错），润肠通便（B错）。便秘之气秘【症状】大便干结，或不甚干结，欲便不得出，或便出不爽，胸胁痞满，肠鸣矢气，腹中胀痛，嗳气频作，纳食减少。舌苔薄腻，脉弦。【治法】顺气导滞（C错）。便秘之冷秘【症状】大便艰涩，腹痛拘急，胀满拒按，胁下偏痛，手足不温，呃逆呕吐。舌苔白腻，脉弦紧。【治法】温里散寒，通便止痛（D错）。